关于皮质核束的说法错误的是
A. 其细胞体位于中央前回上部和旁中央小叶前部
B. 经过内囊膝部
C. 在脑干内下行
D. 大部分终止于两侧脑神经运动核
E. 舌下神经核和面神经下核部仅接受对侧的纤维

正确答案：A。其细胞体位于中央前回上部和旁中央小叶前部

解析：皮质核束其细胞体位于中央前回下部（A错，为本题正确选项），在脑干内下行（C对），下行经过内囊膝部（B对），大部分终止于两侧脑神经运动核（D对）,舌下神经核和面神经下核部仅接受对侧的纤维（E对）。